小李，男，25岁。硕士研究生毕业后参加工作。半年来对上级领导布置的任务总感觉不能胜任，屡屡出错，受到多次批评后内心受挫，选择了辞职。小李的这种选择在应激反应属于
A. 认知反应
B. 生理反应
C. 情绪反应
D. 行为反应
E. 防御反应

正确答案：D。行为反应

解析：应激反应包括心理性应激反应和生理性应激反应，生理性应激反应（B错）指个体在应激源的刺激下，体内一系列的生理变化，如心率加快、血压升高、腺体分泌等；生理性应激反应包括应急反应和伴有负性情绪且个体认为没有应对可能性的应激反应，而防御反应（E错）是动物的应急反应，属于生理性应激反应。心理性应激反应包括情绪性应激反应、认知性应激反应、行为性应激反应；行为性应激反应指当个体经历应激源刺激后，常自觉或不自觉在行为上发生改变，包括积极的行为应激反应（问题解决策略及情绪缓解策略）和适应不良的行为性应激反应（包括逃避、回避、退化、依赖、敌对、攻击、无助、自怜、物质滥用），小李受到多次批评（应激源）后内心受挫，选择了辞职（提前远离应激源），即回避，属于行为反应（D对）；情绪性应激反应（C错）指个体在不同应激源的刺激下，产生程度不同的情绪反应，包括焦虑、抑郁、恐惧、愤怒；认知性应激反应（A错）指激时唤起注意和认知过程，以适应和应对外界环境变化，包括意识障碍（意识朦胧、意识范围狭小）、注意力受损（注意力集中困难、注意力范围狭窄等）、记忆、思维、想象力减退等。